不属于脂质体作用特点的是
A. 具有靶向性和淋巴定向性
B. 药物相容性差，只适宜脂溶性药物
C. 具有缓释作用，可延长药物作用时间
D. 可降低药物毒性，适宜毒性较大的药物
E. 结构中的双层膜有利于提高药物稳定性

正确答案：B。药物相容性差，只适宜脂溶性药物

解析：本题考查脂质体作用特点。不属于脂质体作用特点的是药物相容性差，只适宜脂溶性药物（B错，为本题正确答案）。脂质体是指将药物包封于类脂质双分子层内而形成的微小囊泡，又称类脂小球、液晶微囊，脂溶性和水溶性的药物均可制成脂质体。脂质体的作用特点有：①靶向性和淋巴定向性（A对）；②缓释和长效性，可延长药物作用时间（C对）；③细胞亲和性与组织相容性；④降低药物毒性，适宜毒性较大的药物（D对）；⑤提高药物稳定性，脂质体结构中的双层膜有利于提高药物稳定性（E对）。